苏合香丸具有芳香开窍、行气止痛的功效，用于痰迷心窍所致的痰厥昏迷、中风偏瘫、肢体不利、以及中暑心胃气痛。处方组成：苏合香、安息香、水牛角浓缩粉、檀香、沉香、丁香等十五味药材。以上十五味除苏合香、人工麝香冰片、水牛角浓缩粉外朱砂水飞成极细粉；其余安息香等十味粉碎成粉；将人工麝香片、水车角浓缩粉研细与上述粉末配研混匀。再将苏合香炖化加适量炼蜜与水制成水蜜丸低温干燥；或加适量炼蜜制成大蜜丸即得。处方中来源于瑞香科以含有树脂的木材入药的饮片是
A. 檀香
B. 苏合香
C. 沉香
D. 木香
E. 安息香

正确答案：C。沉香

解析：本题考查的是沉香的来源。处方中来源于瑞香科以含有树脂的木材入药的饮片是沉香（C对）。沉香：【来源】为瑞香科植物白木香含有树脂的木材。檀香（A错）的药用部位是心材部分。苏合香（B错）：【来源】金缕梅科植物苏合香树的树干渗出的香树脂，经加工精制而成。木香（D错）：【来源】为菊科植物木香的干燥根。安息香（E错）：【来源】安息香科植物白花树的干燥树脂。